人口自然增长率计算公式正确的是
A. 自然增长率=粗再生育率－粗死亡率
B. 自然增长率=粗出生率－粗死亡率
C. 自然增长率=净再生育率－粗死亡率
D. 自然增长率=总和生育率－粗死亡率
E. 自然增长率=总生育率－粗死亡率

正确答案：B。自然增长率=粗出生率－粗死亡率